对于白血病最有诊断意义的是
A. 血液检查
B. CT检查
C. B超检查
D. 骨髓象检查
E. 临床症状

正确答案：D。骨髓象检查

解析：白血病由于发病时骨髓中异常的原始细胞及幼稚细胞大量繁殖所以骨髓象检查是诊断白血病最有意义的检查（D对）。根据血液检查和临床症状可协助诊断（AE错）。白血病根据临床症状、血液检查和骨髓象的特点一般可明确诊断，一般不需要CT和B超检查（BC错）。